人体实验的实施过程
A. 不是必须由受过严格训练的人员指导监督
B. 受试者在实验过程中不能取消承诺
C. 必须在医院进行
D. 是受试者必须绝对服从实验者的过程
E. 要遵守减轻对受试者肉体及精神上伤害的原则，必要时可中断实验

正确答案：E。要遵守减轻对受试者肉体及精神上伤害的原则，必要时可中断实验

解析：人体实验要遵守减轻对受试者肉体及精神上伤害的原则，必要时可中断实验。受试者有拒绝参加研究及随时退出研究的权利等（E对）。在人体实验必须有医学研究专家或经验丰富的专家共同参与试验或指导试验全程（A错）。受试者有拒绝参加研究及随时退出研究的权利等（B错）。人体实验不是必须在医院进行（C错）。受试者的自我决定权是指具有行为能力的受试者享有在较充分的相关信息之基础上，就人体试验的相关事项（是否参加试验、是否退出试验等）独立做出决定的权利（D错）。